慢性化率最高的病毒性肝炎是
A. 乙型肝炎
B. 甲型肝炎
C. 丙型肝炎
D. 丁型肝炎病毒单独感染
E. 戊型肝炎

正确答案：C。丙型肝炎

解析：丙型肝炎（C对）感染后慢性化率为50%～85%，慢性化的机制主要有：HCV的高度变异性；HVC对肝外细胞的泛嗜性，特别是存在于外周血单个核细胞中的HCV，可能成为反腐感染肝细胞的来源；机体HCV免疫应答水平低下，甚至产生耐受，造成病毒持续感染。在青少年和成人感染乙型肝炎（A错）者，仅有5%～10%发展成为慢性，而在围生期和婴幼儿时期感染HBV者，分别有90%和25%～30%发展成为慢性。甲型肝炎（B错）少见慢性患者。慢性丁型肝炎是指在原有慢性HBV感染的基础上有重叠HDV感染，因此丁型肝炎病毒单独感染（D错）不会出现慢性丁型肝炎。戊型肝炎（E错）少见慢性患者。